患者，男，30岁。瘿肿目突，急躁易怒，烦热多汗，面部烘热，口干口苦，多食消瘦，两手颤抖，舌红苔黄腻，脉弦滑而数。其证型是
A. 肝郁化火
B. 肝郁痰壅
C. 痰阻血瘀
D. 肝火痰瘀
E. 肝郁痰热

正确答案：D。肝火痰瘀

解析：患者瘿肿目突，病为瘿瘤。肝火上扰，故急躁易怒，烦热多汗，面部烘热，口干口苦；火盛伤阴，不能濡养经脉，故见多食消瘦，两手颤抖；舌红苔黄腻，脉弦滑而数为肝火痰瘀的表现（D对ABCE错）。